单纯疱疹病毒核衣壳是由
A. 160个壳微粒组成
B. 161个壳微粒组成
C. 162个壳微粒组成
D. 163个壳微粒组成
E. 164个壳微粒组成

正确答案：C。162个壳微粒组成

解析：本题考查单纯疱疹病毒。单纯疱疹病毒核衣壳是由162个壳微粒组成（C对）。单纯疱疹病毒（HSV）是最早发现的人类疱疹病毒，属于疱疹病毒科、a疱疹病毒亚科、单纯病毒属的双链DNA病毒。病毒颗粒呈球形，直径为120～150nm，核衣壳表面是由162个壳微粒组成的对称二十面体，核衣壳周围有一层被膜，最外层是包膜，含有病毒编码的糖蛋白。病毒基因组DNA长约152kb，病毒核壳由脂质糖蛋白包裹，具有嗜神经组织特性。病毒在细胞核内复制和装配，通过核膜出芽，由胞吐或细胞溶解方式释放病毒，病毒可通过细胞间桥直接扩散，感染细胞同邻近未感染的细胞融合，形成多核巨细胞。